自然灾害发生后，饮用水卫生要求在流行病学上安全，主要是为了确保不发生
A. 消化道疾病
B. 介水传染病
C. 食物中毒
D. 急慢性中毒
E. 水型地方病

正确答案：B。介水传染病

解析：本题考查介水传染病。自然灾害发生后，饮用水卫生要求在流行病学上安全，主要是为了确保不发生介水传染病（B对ACDE错）。介水传染病指通过饮用或接触受病原体污染的水而传播的疾病。